某人群某年糖尿病患者心肌梗死的死亡与总人群心肌梗死预期死亡的研究中，糖尿病患者心肌梗死死亡人数15000人，该人群预期死亡数为8000人。SMR等于
A. 7000
B. 0.533
C. 0.467
D. 1.88
E. 不能计算

正确答案：D。1.88